下列有关双相障碍的治疗的选项中正确的是
A. 双相障碍几乎终生以循环方式反复发作，应坚持长期治疗原则以阻断反复发作
B. 不论双相障碍为何种临床类型，不必全部以心境稳定剂为主要治疗药物
C. 双相障碍抑郁发作时，在心境稳定剂使用的基础上不可联用抗抑郁药物
D. 药物联用方式只有多种心境稳定剂联合使用
E. 不需要应定期对血锂浓度进行动态监测

正确答案：A。双相障碍几乎终生以循环方式反复发作，应坚持长期治疗原则以阻断反复发作